女，70岁。蛋白尿1个月，尿蛋白6g/L。尿蛋白电泳显示以小分子蛋白为单株峰。其蛋白尿的性质为
A. 组织性蛋白尿
B. 溢出性蛋白尿
C. 肾小管性蛋白尿
D. 分泌性蛋白尿
E. 肾小球性蛋白尿

正确答案：B。溢出性蛋白尿

解析：老年女性患者，蛋白尿1个月，尿蛋白6g/L（正常为0～0.08g/d，提示有大量蛋白尿），尿蛋白电泳显示以小分子蛋白为单株峰，提示患者蛋白尿的性质为溢出性蛋白尿（B对），是血中小分子量蛋白质异常增多，从肾小球滤出，超过了肾小管重吸收阈值所致。